下述关于“腮腺鞘”的叙述中哪项是错误的
A. 腮腺鞘来自颈深筋膜浅层
B. 腮腺鞘与腮腺紧密结合，并发出间隔伸入腺体
C. 鞘的浅层致密，深层薄弱
D. 鞘的上部与外耳道紧密相连，并有纤维束伸入外耳道
E. 鞘的深层附于颅底，且增厚成蝶下颌韧带

正确答案：E。鞘的深层附于颅底，且增厚成蝶下颌韧带

解析：腮腺咬肌筋膜形成腮腺鞘，特点为浅层特别致密，深层薄弱；鞘与腺体结合紧密，并发出许多间隔伸入腺体；鞘的上部与外耳道紧密相连，并发出索状纤维束伸入外耳道前下壁软骨部的裂隙（Santorini裂隙）。茎突和下颌角之间的部分筋膜纤维增厚，形成茎突下颌韧带。腮腺鞘浅层与腺体紧密相连并附着于颧弓。掌握“腮腺咬肌区、腮腺与面神经解剖关系”知识点。